对动力单元的描述，正确的是
A. 一个动力单元可以完成复杂动作
B. 动力单元由肌肉、骨骼、神经等组成
C. 一般来说，组织劳动生产时，要尽可能多地动用动力单元
D. 两个以上动力单元组合在一起称为动力链
E. 胃、肠蠕动也属于动力单元运动

正确答案：D。两个以上动力单元组合在一起称为动力链